关于癌基因的叙述，错误的是
A. 是细胞增生的正调节基因
B. 可诱导细胞凋亡
C. 能在体外引起细胞转化
D. 能在体内诱发肿瘤
E. 包括病毒癌基因和细胞癌基因

正确答案：B。可诱导细胞凋亡